右肾前面邻接
A. 肝
B. 盲肠
C. 空肠
D. 胆囊
E. 膈

正确答案：A。肝

解析：右肾前邻肝(A对)、结肠右曲。